艾滋病患者机会性感染最常见的疾病是
A. 巨细胞病毒性视网膜炎
B. 脑弓形虫病
C. 肺孢子菌肺炎
D. 卡波济肉瘤
E. 口腔念珠菌病

正确答案：C。肺孢子菌肺炎

解析：肺孢子菌肺炎（C对）是最常见的艾滋病合并感染，在未经肺孢子菌肺炎（PCP）预防用药和抗病毒治疗前，约70～80％的HⅠV感染者会发生这种机会性感染；巨细胞病毒性视网膜炎（A错）在艾滋病患者机会性感染的病毒感染（90％）中约近三成；脑弓形虫病（B错）是艾滋病患者机会性感染中弓形虫感染的最常见类型；卡波济肉瘤（D错）和口腔念珠菌病（E错）都是艾滋病患者机会性感染的常见类型，但不如肺孢子菌肺炎多见。